临床上壶腹癌最重要的症状是
A. 黄疸
B. 上腹疼及腰背疼
C. 寒战、发热
D. 消化道症状
E. 贫血、消瘦

正确答案：A。黄疸

解析：临床上壶腹癌最重要的症状是黄疸（A对）。壶腹癌可导致胆汁下行受限，早期即可出现黄疸，往往是第一症状和体征。黄疸呈进行性加重，可有轻微波动，多由肿瘤破溃坏死，癌组织脱落，使梗阻减轻所致。上腹疼及腰背疼（B错）可见于腹部多种疾病，缺乏特异性。寒战、发热（C错）为感染性疾病的临床表现。消化道肿瘤大多存在消化道症状（D错）及贫血、消瘦（E错）等。